含磺酰胺基的非甾体抗炎药是
A. 舒林酸
B. 吡罗昔康
C. 别嘌醇
D. 丙磺舒
E. 秋水仙碱

正确答案：B。吡罗昔康

解析：本题考查含磺酰胺基的非甾体抗炎药。吡罗昔康（B对）为苯并噻嗪类非甾体抗炎药，含磺酰胺基；舒林酸（A错）含甲基亚砜基，不含有磺酰胺基；别嘌呤（C错）、丙磺舒（D错）、秋水仙碱（E错）均为抗痛风药物。